属心而络于胞中的经脉是
A. 冲脉
B. 胞脉
C. 任脉
D. 督脉
E. 带脉

正确答案：B。胞脉

解析：《素问·评热病论》曰：“胞脉者，属心而络胞中”，胞络、胞脉是附于胞宫并联属心肾的脉络（B对）。冲脉：起于肾下胞中，经会阴，出于气街，并于足少阴肾经，挟脐上行，至胸中而散。分支：从胸中上行，会咽喉，络唇口，其气血渗诸阳，灌诸精。从气街下行，并足少阴经，循阴股内廉。入腘中，行胫内廉，至内踝后，渗三阴。从内踝后分出，行足背，入大趾内间。从胞中向后，行与脊内（A错）。任脉：起于胞中，出于会阴，上循毛际，循腹里，上关元，至咽喉，上颐循面入目。分支：从胞中向后行于脊内。络脉：任脉之别，名曰尾翳，下鸠尾，散于腹（C错）。督脉：起于少腹以下骨中央（胞中），下出会阴，经长强，行于后背正中，上至风府，入属于脑，上巅，循额，至鼻柱，经素髎、水沟，会手足阳明，至兑端，入龈交。分支：其少腹直上者，灌脐中央，上贯心，入喉，上颐，还唇，上系两目之下中央。络脉：督脉之别，名曰长强，挟膂上项，散头上，下当肩胛左右，别走太阳，入贯膂（D错）。带脉：起于季胁，回腰一周（E错）。